心理治疗对治疗师的要求不包括
A. 要有一颗帮助别人的心
B. 要有一个敏锐的观察力
C. 要遵守职业道德
D. 每天要具备好的心情
E. 要有丰富的生活经验和知识

正确答案：D。每天要具备好的心情

解析：心理治疗对治疗师的要求：要有一颗帮助别人的心；要有一个敏锐的观察力、要有丰富的生活经验和知识；要具备乐观的生活态度；要遵守职业道德。掌握“心理治疗原则、主要方法及应用”知识点。